津伤化燥，产生“内燥”病变，以哪些脏腑为多见
A. 肺胃三焦
B. 肺肾三焦
C. 肝胃大肠
D. 肺胃大肠
E. 肺脾肾

正确答案：D。肺胃大肠

解析：肺胃生理特性都有喜润恶燥，大肠传化糟粕，且大肠主津，易津伤化燥，燥屎内结；故产生内燥的脏腑以肺胃大肠多见（D对）。肝体阴而用阳，津伤化燥不多，肾主水，主持调节水液代谢，脾喜燥恶湿，津伤化燥不常见，小肠主液津伤化燥不常见，三焦为为水道通行场所（ABCE错）。